在海平面条件下，诊断成年人有呼吸衰竭的根据之一一是PaO₂值
A. ＜5.3kPa(40mmHg)
B. ＜6.7kPa(50mmHg)
C. ＜8.0kPa(60mmHg)
D. ＜9.3kPa(70mmHg)
E. ＜10.6kPa(80mmHg)

正确答案：C。＜8.0kPa(60mmHg)

解析：在海平面条件下，诊断成年人有呼吸衰竭的根据之一一是PaO₂值＜8.0kPa(60mmHg)（C对）。